关于腓深神经的说法中,有何错误
A. 为腓总神经的分支
B. 沿小腿前肌群之间下降
C. 伴胫前动脉至踝关节前方
D. 分布于足背皮肤
E. 分布于小腿前肌群

正确答案：D。分布于足背皮肤

解析：腓深神经为腓总神经的分支（A对），在腓骨与腓骨长肌之间斜向前行，伴随胫前血管于胫骨前肌和趾长伸肌之间（C对），继而在胫骨前肌与姆长伸肌之间下行（B对），最后经踝关节前方达足背。沿途发出分支分布于小腿前群肌（E对）、足背肌及第1、2趾相对缘的皮肤（D错，为本题正确选项）。